有关房水循环的描述中，错误的是
A. 房水由晶状体产生
B. 自眼后房经瞳孔流入眼前房
C. 在虹膜角膜角处渗透进入虹膜静脉窦
D. 有折光作用

正确答案：A。房水由晶状体产生

解析：房水由睫状体产生，而非由晶状体产生（A错，为本题正确答案）。房水自眼后房经瞳孔流入眼前房（B对），在虹膜角膜角处渗透进入虹膜静脉窦（C对）。房水属于眼球内容物，有折（屈）光作用（D对）。